患儿，女，3岁。突发高热，神志不清，西医诊断为病毒性脑膜炎，指纹紫黑达食指端，提示
A. 邪气入络
B. 邪气入经
C. 邪入脏腑，病情较重
D. 病情凶险，预后不良
E. 疼痛证

正确答案：D。病情凶险，预后不良

解析：患儿指纹色紫黑，为血络郁闭，多属病危之象；且指纹直达指端，称为“透关射甲”，提示病情凶险，预后不良（D对）。指纹显于风关，是邪气入络，邪浅病轻，可见于外感初起（A错）。指纹达于气关，是邪气入经，邪深病重（B错）。指纹达于命关，是邪入脏腑，病情较重（C错）。指纹色青，主疼痛（E错）、惊风，因痛则不通，或肝风内动，脉络郁滞，以致气血运行不畅，故纹色变青紫。